以下哪种病变X线片表现为根尖周圆形低密度透射区，边缘有一薄层密质白线
A. 急性根尖周炎
B. 慢性根尖脓肿
C. 根尖肉芽肿
D. 根尖囊肿
E. 牙骨质增生

正确答案：D。根尖囊肿

解析：本题考查根尖周囊肿。根尖囊肿（D对）X线片表现为根尖周圆形低密度透射区，边缘有一薄层密质白线。根尖周囊肿：①无自觉症状，叩诊可有异样感。②囊肿发展较大时，根尖部相应的组织膨隆，扪有乒乓球感。③X线检查：根尖周圆形透射区（豌豆大至鸡蛋大），有阻射的白线围绕。④根管治疗时根管内流出淡黄色清亮囊液，其涂片镜下见胆固醇结晶。